炉甘石洗剂为混悬液型液体制剂，其中所含甘油是用作
A. 增溶剂
B. 润湿剂
C. 抑菌剂
D. 助悬剂
E. 助溶剂

正确答案：D。助悬剂

解析：本题考查的是混悬液的添加剂。炉甘石洗剂为混悬液型液体制剂，其中所含甘油是用作助悬剂（D对）。为了增加混悬剂的物理稳定性，在制备时需加入能使混悬剂稳定的附加剂，包括润湿剂、助悬剂、絮凝剂和反絮凝剂等。（1）润湿剂（B错）：系指疏水性药物制备混悬剂时，常加入以利于分散的附加剂。常用的润湿剂有吐温类、司盘类表面活性剂等。（2）助悬剂：能增加分散介质的黏度、降低微粒的沉降速度，同时能被药物微粒表面吸附形成机械性或电性保护膜，防止微粒间互相聚集或产生晶型转变，或使混悬液具有触变性，从而增加其稳定性的附加剂。常用助悬剂：①低分子助悬剂，如甘油、糖浆剂等。②高分子助悬剂，主要分为天然和合成高分子助悬剂。常用的天然高分子助悬剂及其用量分别为阿拉伯胶5%～15%、西黄蓍胶0.5%～1%、琼脂0.3%～0.5%，此外尚有海藻酸钠、白及胶、果胶等。常用的合成高分子助悬剂有甲基纤维素、羧甲纤维素钠、羟乙纤维素、聚维酮、聚乙烯醇等，一般用量为0.1%～1.0%，此类助悬剂性质稳定，受pH影响小，但与某些药物有配伍变化。③硅酸类，如胶体二氧化硅、硅酸铝、硅皂土等。（3）絮凝剂与反絮凝剂：加入适量的电解质可使混悬剂中微粒周围双电层形成的ζ电位降低到一定程度，使得微粒间吸引力稍大于排斥力，形成疏松的絮状聚集体，经振摇又可恢复成分散均匀混悬液的现象叫絮凝，所加入的电解质称为絮凝剂。加入电解质后使ζ电位升高，阻碍微粒之间碰撞聚集的现象称为反絮凝，能起反絮凝作用的电解质称为反絮凝剂，加入适宜的反絮凝剂也能提高混悬剂的稳定性。同一电解质可因用量不同起絮凝作用或反絮凝作用，如枸橼酸盐、枸橼酸氢盐、酒石酸盐、酒石酸氢盐、磷酸盐及一些氯化物等。增溶剂（A错）、抑菌剂（C错）与助溶剂（E错）为注射剂的添加剂。配制注射制剂时，可根据需要加入适宜的附加剂，如渗透压调节剂、pH调节剂、增溶剂、助溶剂、抗氧剂、抑菌剂、乳化剂、助悬剂等。